一中年男性，体胖，有高血压、高脂血症病史，近来有心前区疼痛出现。心绞痛的部位以下哪一样具有特征性
A. 心尖区
B. 胸骨旁1cm
C. 胸骨体上段或中段之后
D. 整个心前区
E. 胸骨体下段

正确答案：C。胸骨体上段或中段之后